温脾汤的主治证是
A. 阳虚寒积证
B. 气虚便秘证
C. 脾虚泄泻证
D. 脾肾两虚、精血不足证
E. 阳虚水饮内停证

正确答案：A。阳虚寒积证

解析：温脾汤的主治证是阳虚寒积证，因脾阳不足，阴寒内盛，寒积中阻所致。为治疗脾阳不足，寒积中阻的常用方（A对）。气虚便秘证宜用黄芪汤（B错）。脾虚泄泻证宜用参苓白术散（C错）。脾肾两虚、精血不足证宜用寿胎丸合四君子汤（D错）。阳虚水饮内停证宜用真武汤（E错）。